属于嵌体适应证的是
A. 青少年的恒牙和儿童乳牙
B. （牙合）面缺损范围小且表浅
C. 固定桥的基牙已有龋洞或需要放置栓体或栓槽附着体
D. 牙体缺损范围大，残留牙体组织抗力形差，固位不良
E. 对美观及长期效果要求高的前牙缺损年轻患者

正确答案：C。固定桥的基牙已有龋洞或需要放置栓体或栓槽附着体

解析：本题考查嵌体的适应证。一般来说，牙体缺损经牙体预备后，当剩余牙体组织可以耐受功能状态下的各向力而不致折裂，并能为嵌体提供足够固位形时，则为嵌体修复的适应证，包括固定桥的基牙已有龋洞或需要放置栓体或栓槽附着体（C对）。嵌体修复也有其临床注意事项和禁忌症：青少年的恒牙和儿童乳牙（A错）的牙体组织较薄且处于发育期，不适宜嵌体修复、全冠修复等修复手段；牙合面缺损范围小且表浅（B错）的患牙不能提供较强的固位力，而嵌体修复磨除的牙体组织较多，不适宜嵌体修复；牙体缺损范围大，残留牙体组织抗力形差，固位不良（D错）的患牙不能提供良好的固位形，不能取得良好的固位力，不适宜嵌体修复。而对于对美观及长期效果要求高的前牙缺损年轻患者（E错），由于嵌体的固位力相对其他修复体较差，且累及前牙唇面时对美观影响较大，故不适宜嵌体修复。